患者，男，50岁。患消渴病5年，症见腰膝酸软、头晕耳鸣、骨蒸潮热、盗汗遗精、消渴。中医辨为肾阴虚证，处以六味地黄汤，药用熟地黄24g，酒萸肉12g、山药12g、泽泻9g、牡丹皮9g、茯苓9g。7剂，每日一剂，水煎服。药师调配复核时，其中呈圆形或椭圆形厚片，切面黄白色至淡黄色，粉性，气微，味微苦的饮片是
A. 熟地黄
B. 酒萸肉
C. 泽泻
D. 山药
E. 牡丹皮

正确答案：C。泽泻

解析：本题考查的是泽泻饮片的性状鉴别。药师调配复核时，其中呈圆形或椭圆形厚片，切面黄白色至淡黄色，粉性，气微，味微苦的饮片是泽泻（C对）。泽泻：【性状鉴别】饮片为圆形或椭圆形厚片。外表皮淡黄色至淡黄棕色，可见细小突起的须根痕。切面黄白色至淡黄色，粉性，有多数细孔。气微，味微苦。熟地黄（A错）：【性状鉴别】饮片为不规则的块片、碎块，大小、厚薄不一。表面乌黑色，有光泽，黏性大。质柔软而带韧性，不易折断，断面乌黑色，有光泽。气微，味甜。酒萸肉（B错）：【性状鉴别】饮片形如山茱萸，表面紫黑色或黑色，质滋润柔软。微有酒香气。山药（D错）：【性状鉴别】饮片山药片为类圆形、椭圆形或不规则形的厚片，表面类白色或淡黄白色。质脆，易折断，切面类白色，富粉性。气微，味淡、微酸，嚼之发黏。牡丹皮（E错）：【性状鉴别】饮片呈圆形或卷曲形的薄片。连丹皮外表面灰褐色或黄褐色，栓皮脱落处粉红色；刮丹皮表面红棕色或淡灰黄色。内表面有时可见发亮的结晶，切面淡粉红色，粉性。气芳香，味微苦而涩。